涂抹化妆品后引起的皮损，特点为起病急、有红斑、丘疹和少量渗出，边界清楚。最大可能是
A. 光变应性接触性皮炎
B. 光毒性皮炎
C. 变应性接触性皮炎
D. 刺激性接触性皮炎
E. 化妆品痤疮

正确答案：D。刺激性接触性皮炎

解析：本题考查刺激性接触性皮炎。刺激性接触性皮炎是化妆品引起皮肤损伤中最常见的病变。化妆品引起的刺激性接触性皮炎（D对ABCE错），皮损限于接触部位，边界清楚。皮炎呈急性或亚急性，以红斑、丘疹、水肿、水疱为主，水疱溃破后可有糜烂、渗液、结痂，自觉病变部位有瘙痒、灼热或疼痛感。